某女暑假经常是白天上网，晚上躺在床上看小说。等到开学，发现黑板上的字看不太清楚，便去校医室检查。检查右眼时，5.0和4.9行视标都看不清，4.8行认错2个，4.7行认错1个，4.6行全部认对。左眼检查结果相同。其左眼视力为
A. 4.6
B. 4.7
C. 4.8
D. 4.9
E. 5

正确答案：B。4.7